刺激胰岛B细胞释放胰岛素的药物是
A. 胰岛素
B. 磺酰脲类
C. A和B均有效
D. A和B均无效

正确答案：B。磺酰脲类

解析：本题考查磺酰脲类的作用。磺酰脲类药物（B对）主要刺激胰岛B细胞并促使胰岛素释放增加。胰岛素（A错）主要用于防治重型或胰岛功能基本丧失的幼年型糖尿病；轻、中度经饮食和口服降糖药治疗无效者；重度消瘦营养不良者；合并严重代谢紊乱（如酮症酸中毒、高渗性昏迷或乳酸酸中毒）、重度感染、消耗性疾病（如肺结核、肝硬化）和进行性视网膜、肾、神经等病变以及急性心肌梗死、脑血管意外者；合并妊娠、分娩及大手术者；用于纠正细胞内缺钾。